构成腹股沟管前壁的组织结构是
A. 腹横肌
B. 腹横筋膜
C. 腹股沟韧带
D. 腔隙韧带
E. 腹外斜肌腱膜

正确答案：E。腹外斜肌腱膜

解析：腹股沟管是腹壁的薄弱区，为腹股沟疝的好发部位。腹股沟管位于腹前外侧壁的下部、腹股沟韧带内侧半的上方，由外上斜向内下，长约4～5cm，男性的精索或女性的子宫圆韧带由此通过。腹股沟管有两口、四壁。内口称腹股沟管深（腹）环，位于腹股沟中点上方2cm处，；外口即腹股沟管浅（皮下）环。前壁由腹外斜肌腱膜（E对）和腹内斜肌构成；后壁为腹横筋膜（B错）、腹膜和腹股沟镰；上壁为腹内斜肌和腹横肌的弓状下缘（A错）；下壁为腹股沟韧带（C错）和腔隙韧带（D错）。